心理咨询的意义有以下方面，但除外
A. 解除紧张应激压力的手段
B. 防治心身疾病
C. 政治思想教育的重要手段
D. 促进健康长寿
E. 心理卫生知识的传播途径

正确答案：C。政治思想教育的重要手段